蒲黄的炮制宜用
A. 炒黄法
B. 炒焦法
C. 炒炭法
D. 麸炒法
E. 米炒法

正确答案：C。炒炭法

解析：本题考查的是蒲黄的炮制方法。蒲黄的炮制宜用炒炭法（C对）。蒲黄：【炮制方法】处方用名有蒲黄、生蒲黄、炒蒲黄、蒲黄炭。①蒲黄：取原药材，揉碎结块，除去花丝及杂质。②蒲黄炭：取净蒲黄，置炒制容器内，用中火加热，炒至棕褐色，喷淋少量清水，灭尽火星，取出晾干。蒲黄为花粉类药物，质轻松，炒制时火力不可过大，出锅后应摊晾散热，防止复燃，检查确已凉透，方能收贮。如喷水较多，则需晾干，以免发霉。炒黄法（A错）是将净制或切制过的药物，置炒制容器内，用文火或中火加热，并不断翻动或转动，使药物表面呈黄色或颜色加深，或发泡鼓起，或爆裂，并逸出固有气味的方法。炒焦法（B错）是将净选或切制后的药物，置炒制容器内，用中火或武火加热，炒至药物表面呈焦黄或焦褐色，内部颜色加深，并具有焦香气味。炒焦的目的：主要是增强药物消食健脾的功效或减少药物的刺激性，如山楂、栀子等。麸炒法（D错）是将净制或切制后的药物用麦麸熏炒的方法。麸炒的目的：①增强疗效，如山药、白术、芡实等。②缓和药性，如苍术、枳实、薏苡仁等。③矫臭矫味，如僵蚕等。米炒法（E错）是将净制或切制后的药物与米同炒的方法。米炒的目的：①增强药物的健脾止泻作用，如党参。②降低药物的毒性，如红娘子、斑蝥。③矫正不良气味，如昆虫类药物。